乳牙的根尖周组织疾病
A. 会影响乳牙根的正常吸收
B. 阻止或延迟乳牙的正常替换
C. 影响继承恒牙胚的发育方向
D. 影响继承恒牙胚的正常发育
E. 以上都是

正确答案：E。以上都是

解析：本题考查乳牙牙髓病和根尖周病必须及时治疗的目的。当乳牙患根尖周炎时，根尖周炎症细胞可刺激破牙本质细胞、破骨细胞，使之活跃，加之乳牙牙根钙化程度低，会影响乳牙根的正常吸收（A对），导致牙根吸收速度加快。乳牙根尖周病变可导致乳牙早失，恒牙萌出间隙不足，影响恒牙胚的发育方向（C对），造成恒牙异位萌出。恒牙异位萌出，可阻止或延迟乳牙的正常替换（B对），引起乳牙滞留。乳牙根尖周病，炎症可累及恒牙胚，影响继承恒牙胚的正常发育（D对），可能导致继承恒牙釉质发育不全，称为Turner牙。（ABCD均对，故E为本题的正确答案）。